男，45岁。不明原因发热半个月。查体：T38℃，两侧颈部。腋窝和腹股沟区均可触及淋巴结肿大，最大者3cm×2cm，均质韧。活动，无压痛，肝肋下2cm，脾肋下4cm。颈部淋巴结活检诊断为非霍奇金淋巴瘤。要确定该患者的临床分期，所需的辅助检查不包括
A. 腹部B超
B. 骨髓细胞学检查
C. 浅表淋巴结B超
D. 盆腔CT
E. 胸部CT

正确答案：C。浅表淋巴结B超

解析：患者中年男性，以不明原因发热为主要表现，查体全身性淋巴结肿大，均质韧、活动、无压痛，排除肿瘤转移和淋巴结炎，考虑淋巴瘤，颈部淋巴结活检确诊为非霍奇金淋巴瘤。辅助检查，浅表淋巴结B超（C错，为本题正确答案），可以发现体检时触诊的遗漏，但并不是必须，为最佳答案（P589）。腹部B超（A对）检查的准确性不及腹部CT，重复性差，受肠气干扰较严重，但在无CT设备时仍不失为一种较好的检查方法（P589）。骨髓细胞学检查（B对）对非霍奇金淋巴瘤的诊断有重要作用（P589）。盆腔淋巴结的检查CT（D对）可以发现盆腔淋巴结病灶（P589）。胸部CT（E对）可确定纵隔与肺门淋巴结肿大（P589）。